下列哪项不是虚证的临床表现
A. 两便失禁
B. 自汗盗汗
C. 面容憔悴
D. 疼痛隐隐
E. 两便不通

正确答案：E。两便不通

解析：虚证常见神疲体倦、疼痛隐隐（D对）、面色无华（C对）、气短、自汗盗汗（B对），或五心烦热，或畏寒肢冷，脉虚无力等表现；肾气虚时出现二便失禁（A对）。二便不通常见于外感病实证（E错，为本题正确答案）。